45岁男性，右下6缺失，右下7稳固，右下5牙周条件差，如按双端固定桥修复，应当设计为
A. 右下5最好设计全冠固位体
B. 右下5最好设计冠内固位体
C. 以右下457为基牙固定义齿修复
D. 降低桥体面的牙尖斜度
E. 适当减少桥体颊舌径

正确答案：C。以右下457为基牙固定义齿修复

解析：本题考查双端固定桥的设计原则。双端固定修复两端的固位力应基本相当，若两端固位力相差悬殊，则固位力弱的一端固位体易松动。患者右下6缺失，5的牙周膜面积小于7，且5的牙周条件较差，因此应在固位力较弱的一端增加基牙数目，设计为以右下457为基牙的固定义齿修复（C对）。固位体类型有冠内固位体（嵌体固位体），冠外固位体（全冠和部分冠），根内固位体三种，其中根内固位体多用于死髓牙，其他固位体类型的固位力大小依次为：全冠＞部分冠＞嵌体（B错）。A本身说法正确，但不属于双端固定桥的修复设计，故（A错）。降低桥体面的牙尖斜度（D错）和适当减少桥体颊舌径（E错）属于减少桥体受力的措施。